枸橼酸铋钾所致的主要不良反应是
A. 腹痛
B. 黑便
C. 皮炎
D. 性功能减退
E. 便秘

正确答案：B。黑便

解析：本题考查药物的不良反应。枸橼酸铋钾所致的主要不良反应是黑便（B对），大量长期服用可有脑、肾毒性。